多器官疾病术前准备不正确的是
A. 心力衰竭需控制3～4周
B. 经常发作哮喘的病人术前可口服地塞米松
C. 肝功能严重损害的病人，一般不宜施行任何手术
D. 肾功能不全的病人，在有效的透析疗法支持下，一般可耐受手术
E. 糖尿病病人术前应控制血糖到正常

正确答案：E。糖尿病病人术前应控制血糖到正常

解析：手术对病人的身理和心理都是极大的负担，病人在整个围手术期都处在应激状态。糖尿病病人术前应将血糖控制在轻度升高的范围（5.6～11.2mmol/L）（E错，为本题正确答案），既不至于因胰岛素过多而发生低血糖，也不至于因胰岛素过少而发生酮症酸中毒。心衰患者心功能差，对于手术的耐受能力明显低于普通人，最好在心衰控制3～4周后再手术（A对）。经常发作哮喘病人，术前口服地塞米松等药物可减轻支气管黏膜水肿（B对）。肝功能不全患者本身耐受能力差，同时凝血系统紊乱，难以耐受手术，因此，肝功能严重损害的病人，一般不宜实行任何手术（C对）。肾功能不全患者，在有效的透析疗法支持下，可极大的改善肾功能，可以较好地耐受手术（D对）。